流感引起季节性流行的主要原因是
A. 机体抵抗力差
B. 环境适宜
C. 流感病毒侵袭力强
D. 传染性强
E. HA和NA容易变异

正确答案：E。HA和NA容易变异